疾病轮状模型的最内环是
A. 环境因素
B. 遗传因素
C. 宿主
D. 特异病原体
E. 病原微生物

正确答案：B。遗传因素

解析：本题考查疾病轮状模型。疾病轮状模型从外到内分别是环境因素、宿主、遗传因素（B对ACDE错）。